具有内分泌干扰作用的污染物是
A. 可吸入颗粒物
B. 铅化合物
C. 多环芳烃
D. 过氧化物
E. 二噁英

正确答案：E。二噁英

解析：本题考查具有内分泌干扰作用的污染物。二噁英（E对ABCD错）是一种有毒有害的有机物，它可以通过空气、水和土壤进入人体，并且具有内分泌干扰作用，可以影响人体的生长发育、免疫功能、神经系统和内分泌系统等。